芦荟的功效有
A. 逐水
B. 泻下
C. 清肝
D. 杀虫
E. 祛痰止咳

正确答案：B、C、D。泻下；清肝；杀虫

解析：本题考查的是芦荟的功效。芦荟的功效有泻下（B对）、清肝（C对）与杀虫（D对）。芦荟：【功效】泻下，清肝，杀虫。巴豆：【功效】泻下冷积，逐水（A错）退肿，祛痰利咽，蚀疮去腐。芫花：【功效】泻水逐饮，祛痰止咳（E错）。外用杀虫疗疮。